微生态制剂可以应用于治疗腹泻的类型有
A. 感染性腹泻后期
B. 消化性腹泻
C. 激惹性腹泻
D. 肠道菌群失调性腹泻
E. 炎症性腹泻

正确答案：A、C、D。感染性腹泻后期；激惹性腹泻；肠道菌群失调性腹泻

解析：本题考查微生态制剂的适应证。微生态制剂主要用于肠道菌群失调引起的腹泻（D对），或由寒冷和各种刺激所致的激惹性腹泻（C对）。但对由细菌或病毒引起的感染性腹泻早期不用，此时应用无效；在应用抗感染药和抗病毒药后期（A对），可辅助给予，以帮助恢复菌群的平衡。消化性腹泻（B错）应用胰酶替代疗法。炎症性腹泻（E错）应使用抗细菌药和抗病毒药。